用于风湿热的辅助诊断的抗链球菌溶血素O试验，其方法是
A. ELISA法
B. 补体结合试验
C. 免疫荧光实验
D. 中和试验
E. 试管凝集试验

正确答案：D。中和试验

解析：抗链球菌溶血素O的试验为中和试验（NT），用于风湿热的辅助诊断。掌握“细菌学、血清学诊断及感染防治”知识点。